长期大剂量使用广谱抗生素导致艰难梭状芽孢杆菌感染性腹泻，首选的治疗药物是
A. 环丙沙星
B. 阿奇霉素
C. 阿米卡星
D. 头孢哌酮
E. 万古霉素

正确答案：E。万古霉素

解析：本题考查万古霉素。长期大剂量使用广谱抗生素导致难辨梭状芽孢杆菌感染性腹泻，首选的治疗药物是万古霉素（E对）。环丙沙星（A错）用于敏感菌感染。阿奇霉素（B错）用于化脓性链球菌引起的急性咽炎、急性扁桃体炎；敏感细菌引起的鼻窦炎、中耳炎、急性支气管炎、慢性支气管炎急性发作；肺炎链球菌、流感嗜血杆菌以及肺炎支原体所致的肺炎。阿米卡星（C错）用于敏感菌所致结膜炎、角膜炎及敏感菌引起严重外伤感染。头孢哌酮（D错）用于敏感产酶菌引起的各种感染的治疗。